病因判定标准中应该放弃的是
A. 关联的时间顺序
B. 关联的强度
C. 关联的特异性
D. 关联的合理性
E. 关联的可重复性

正确答案：C。关联的特异性